上颌第一磨牙拔除用力方向是
A. 主要用摇力，向腭侧力量要大
B. 主要用旋转力，向近中力量要大
C. 主要用摇力，向颊侧力量要大
D. 主要用旋转力，向远中力量要大
E. 以上均不对

正确答案：C。主要用摇力，向颊侧力量要大

解析：本题考查上颌第一磨牙拔除的用力方向。上颌第一磨牙比较坚固，有三根，根分叉大，腭侧根最大，圆锥形，近中颊根多为扁平，远中颊根多为圆形较细，周围骨质坚实，颊侧稍薄，但第一磨牙的颊侧又有颧牙槽突的加强。上颌第一磨牙拔除时，可先用牙挺挺松，再用牙钳先向骨质较薄弱的颊侧，而后向腭侧缓慢摇动，使用摇力时，向颊侧力量要大（C对A错），待牙松动到一定程度，沿阻力小的方向，向下、远中、颊侧牵引拔出。牙拔除时的运动力主要有三种：摇力，旋转力和牵引力。其中旋转力（BD错）主要适用于圆锥形的单根牙，如上颌中切牙和尖牙，多根牙、扁根、弯根牙不能进行扭转，否则将出现断根。